流行性出血性结膜炎宜选用
A. 酞丁安
B. 双氯芬酸
C. 益康唑
D. 羟苄唑
E. 泼尼松

正确答案：D。羟苄唑

解析：本题考查沙眼治疗药。流行性出血性结膜炎由一种微小RNA 病毒感染引起，宜选用抗病毒药羟苄唑（D对）。酞丁安（A错）常用于流行性结膜炎。双氯芬酸（B错）属于非甾体抗炎药，具有抗炎、镇痛及解热作用。用于风湿性关节炎、非炎性关节痛、关节炎、非关节性风湿病、非关节性炎症引起的疼痛，各种神经痛、癌症疼痛、创伤后疼痛及各种炎症所致发热等。益康唑（C错）为咪唑类抗真菌药，主要用于皮肤或黏膜感染，治疗皮肤癣病，如股癣、手足癣及念珠菌阴道炎等。泼尼松（E错）常用于过敏性结膜炎，其不仅可抑制炎症过程的早期表现，还能降低毛细血管壁的通透性，减少炎性物质渗出。